关于热原污染途径的说法，错误的是
A. 从注射用水中带入
B. 从原辅料中带入
C. 从容器、管道和设备带入
D. 药物分解产生
E. 制备过程中污染

正确答案：D。药物分解产生

解析：本题考查热原污染的途径。热原污染的途径包括：①从注射用水中带入；②从原辅料中带入；③从容器、用具、管道和设备等带入；④制备过程中的污染；⑤从输液器带入（D错，为本题正确答案）。